经过冠状窦左端汇入冠状窦的是
A. 左冠状动脉
B. 右冠状动脉
C. 心大静脉
D. 心小静脉
E. 心最小静脉

正确答案：C。心大静脉

解析：心大静脉（C对）伴左冠状动脉前室间支上行，斜向左上进入冠状沟，经过冠状窦左端汇入冠状窦。